女性膀胱后方有
A. 直肠
B. 阴道
C. 回肠
D. 乙状结肠
E. 卵巢悬韧带

正确答案：B。阴道

解析：女性膀胱的后方有子宫和阴道（B对）。